可以导致灰婴综合征的是
A. 庆大霉素
B. 土霉素
C. 林可霉素
D. 氯霉素
E. 四环素

正确答案：D。氯霉素

解析：新生儿和早产儿服用氯霉素（D对）后易出现灰婴综合征，表现为腹胀、呕吐、呼吸抑制乃至皮肤灰白、紫紺，最后循环衰竭、休克，主要是由于新生儿和早产儿肝脏的葡萄糖醛酸转移酶缺乏，且肾脏排泄功能不完善，故对氯霉素解毒能力差。庆大霉素（A错）属于氨基糖阿甘类抗生素，主要不良反应为耳毒性、肾毒性、神经肌肉麻痹、过敏反应等。土霉素（B错）也属于四环素类，不良反应同四环素，胃肠道反应多见。林可霉素（C错）属于林可霉素类抗菌药，其主要的不良发应为胃肠道反应，长期使用肠道菌群被抑制，对此类药物不敏感的难辨梭状芽孢杆菌过度繁殖并产生外毒素，引起伪膜性肠炎，可使用甲硝唑和万古霉素治疗。四环素（E错）类能与新形成的骨、牙组织中沉淀的钙离子结合，造成色素沉着，还可抑制婴儿骨骼的生长。